患者出现寒战，高热，伴有恶心，乏力，食欲减退，肝区出现疼痛，行辅助检查出现环形强化，进一步确诊需作何种检查
A. 肝穿刺检查
B. 超声检查
C. X线检查
D. MRCP检查
E. CT检查

正确答案：A。肝穿刺检查

解析：根据题干中辅助检查出现环形强化，环形强化指影像学扫描做增强扫描时病灶周围有一圈造影剂浓集，并且患者有寒战，高热，提示有感染，所以最有可能诊断为肝脓肿，可在肝区压痛最剧处或超声引导下施行诊断性穿刺予以确诊（A对）。超声检查是基本检查，不能确诊（B错）。X线检查适用于上消化道穿孔、气胸，不能进一步确诊（C错）。MRCP检查适用于胆道结石、胆道肿瘤方面的检查（D错）。CT检查可作为基础检查的进一步检查，但穿刺活检是更为准确（E错）。